药品标准正文内容，除收载有名称、结构式、分子式、分子量与性状外，还载有
A. 鉴别
B. 检查
C. 含量测定
D. 药动学参数
E. 不良反应

正确答案：A、B、C。鉴别；检查；含量测定

解析：本题考查药品标准。我国的国家药品标准主要包括《中华人民共和国药典》、《药品标准》和药品注册标准，其中《药典》包括凡例、通则及各部的标准正文三部分。正文为药品标准的主体，其内容根据品种和剂型不同，按顺序可分别列有：品名（包括中文名、汉语拼音与英文名）、有机药物的结构式、分子式与分子量、来源或有机药物的化学名称、含量或效价的规定、处方、制法、性状、鉴别（A对）、检查（B对）、含量或效价测定（C对）、类别、规格、贮藏制剂及杂质信息等。